为“血中气药”，能“上行头目，下调经水”的药物是
A. 川芎
B. 延胡索
C. 姜黄
D. 莪术
E. 郁金

正确答案：A。川芎

解析：川芎辛香行散，温通血脉，既能活血祛瘀，又能行气通滞，为“血中气药”功善止痛，为治气滞血瘀诸痛证之要药。川芎性善行窜，能“下调经水，中开郁结”，善通达气血，为妇科活血调经要药（A对）。